以增加药物对特定部位作用的选择性为目的，而进行结构修饰得到的药物有
A. 美法仑
B. 匹氨西林
C. 比托特罗
D. 头孢呋辛酯
E. 去氧氟尿苷

正确答案：A、E。美法仑；去氧氟尿苷

解析：本题考查美法仑。美法仑（A对）属于氮芥类药物，其左旋体为L-苯丙氨酸氮芥，L-苯丙氨酸是一个良好的载体，可以增强药物对特定部分作用的选择性。去氧氟尿苷（E对）是氟尿嘧啶类衍生物，在肿瘤组织中转化成5-氟尿嘧啶后发挥选择性抗肿瘤作用。匹氨西林（B错）为半合成青霉素类；比托特罗（C错）为选择性β₂受体激动剂；头孢呋辛酯（D错）为头孢呋辛的乙酰乙酯。